孕7～9月，按中国营养学会2000年建议，每日钙摄入量为
A. 800mg
B. 1000mg
C. 1200mg
D. 1500mg
E. 1800mg

正确答案：C。1200mg

解析：本题考查孕期钙的补给量。我国营养学会推荐的膳食中的钙的供给量标准为：孕1～3个月800mg/天，孕4～6个月为1000mg/天，孕7～9个月1200mg（C对ABDE错）/天。